生命神圣论的积极意义不包括的是
A. 对人的生命的尊重
B. 推行医学人道主义反对非人道的医疗行为
C. 反对不平等的医疗制度
D. 合理公正的分配卫生资源
E. 实行一视同仁的医德规范

正确答案：D。合理公正的分配卫生资源

解析：合理公正的分配卫生资源没有体现生命神圣论对人的看法（D错，为本题正确答案）。生命神圣论强调尊重人的生命，所以生命神圣论的积极意义包括对人的生命的尊重（A对）。推行医学人道主义反对非人道的医疗行为体现了生命神圣论提倡患者的生命利益和健康利益高于一切（B对）。反对不平等的医疗制度体现了生命神圣论提倡患者的生命利益和健康利益高于一切（C对）。实行一视同仁的医德规范体现了生命神圣论提倡患者的生命利益和健康利益高于一切（E对）。